按《中国药典》规定作为洋金花含量测定指标成分的是
A. 大黄素
B. 苦杏仁苷
C. 杜鹃素
D. 盐酸麻黄碱
E. 东茛蓉碱

正确答案：E。东茛蓉碱

解析：本题考查的是洋金花主要化学成分。按《中国药典》规定作为洋金花含量测定指标成分的是东莨菪碱（E对）。洋金花主要化学成分为莨菪烷类生物碱，由莨菪醇类和芳香族有机酸结合生成的一元酯类化合物。主要有莨菪碱（阿托品）、山莨菪碱、东莨菪碱、樟柳碱和N-去甲莨菪碱。《中国药典》以东莨菪碱为指标成分进行含量测定，要求东莨菪碱不得少于0.15%。大黄素（A错）为虎杖的质量控制成分之一。虎杖主要含有蒽醌类化合物：蒽醌类成分包括大黄素、大黄酚、大黄酸等。此外，还含有非蒽醌类的化合物如虎杖苷等。《中国药典》采用高效液相色谱法测定虎杖药材中大黄素和虎杖苷的含量，大黄素不得少于0.60%，虎杖苷不得少于0.15%。苦杏仁苷（B错）为桃仁是质量控制成分。桃仁中的主要化学成分为脂溶性物质、蛋白质、甾醇及其糖苷类、黄酮类、酚酸类等，其中脂溶性成分占桃仁干质量的50%，蛋白质占25%；桃仁含有氰苷化合物，其中苦杏仁苷的量为1.5%～3.0%，《中国药典》以苦杏仁苷为指标成分对桃仁进行含量测定，规定苦杏仁苷含量不得少于于2.0%。杜鹃素（C错）为满山红的质量控制成分。满山红叶中含有杜鹃素、8-去甲基杜鹃素、山柰酚、槲皮素、杨梅素、金丝桃苷、异金丝桃苷以及莨菪亭、伞形酮、木毒素、牻牛儿酮、薄荷醇、杜松脑和α-桉叶醇、β-桉叶醇、γ-桉叶醇等。其中杜鹃素为祛痰成分，临床用于治疗慢性支气管炎。《中国药典》以杜鹃素为对照品对满山红进行含量测定。要求杜鹃素含量不少于0.08%。盐酸麻黄碱（D错）为麻黄的质量控制成分。麻黄中含有多种生物碱，以麻黄碱和伪麻黄碱为主，前者占总生物碱的40%～90%，《中国药典》以盐酸麻黄碱和盐酸伪麻黄碱为指标成分进行含量测定，要求药材和饮片含盐酸麻黄碱和盐酸伪麻黄碱的总量不得少于0.80%。此外麻黄还含少量的甲基麻黄碱、甲基伪麻黄碱和去甲基麻黄碱、去甲基伪麻黄碱。